尿渗透压降低常见于
A. 中枢性尿崩症
B. 甲状旁腺功能亢进症
C. 甲状腺功能亢进症
D. 糖尿病
E. 原发性醛固酮增多症

正确答案：A。中枢性尿崩症

解析：中枢性尿崩症（A对）是指各种原因引起的抗利尿激素合成、转运、储存或释放不足，导致的肾脏尿浓缩功能障碍，其特点为多饮多尿、烦渴、低比重尿和低渗尿。甲状旁腺功能亢进症（B错）的患者甲状旁腺激素增多，可导致血和尿钙、磷增加，尿比重升高，尿渗透压升高。甲状腺功能亢进症（C错）是指甲状腺腺体本身产生甲状腺激素过多而引起的甲状腺毒症，其尿液渗透压无明显变化。糖尿病（D错）的患者尿渗透压可为低渗、等渗或高渗，但多为高渗。原发性醛固酮增多症（E错）患者的尿比重较为固定而减低，少数患者呈低渗尿（P704）。